男，4岁。因反复低热、咳嗽和盗汗15天就诊。查体：T37.5℃，右眼球结膜充血，内眦部有一疱疹，咽部充血，右颈部可触及黄豆大小淋巴結，无明显压痛，心肺无异常，肝肋下1.5厘米，血WBC5.6×10⁹/L，L0.70。若胸部X片示肺门有直径3厘米的圆形致密阴影，其肺部病灶的病理改变应是
A. 渗出、水肿、坏死
B. 充血、水肿、渗出
C. 渗出、增殖、坏死
D. 充血、水肿、坏死
E. 充血、水肿、增殖

正确答案：C。渗出、增殖、坏死

解析：4岁患儿，有低热、盗汗、眼球结膜充血、颈部淋巴结肿大的特征性表现，应诊断为原发性肺结核。原发性肺结核典型的X线表现是肺门哑铃状阴影，其病理改变是渗出、增殖、坏死（C对）。